用于评价癌痛患者疼痛程度的是
A. 数字评分法
B. CTP评分标准
C. Cochrane证据分级
D. APACHE评分系统
E. Beers标准

正确答案：A。数字评分法

解析：本题考查癌痛患者疼痛程度的评价标准。可以采用数字评分法（A对）或笑脸评分法对癌症患者疼痛程度进行量化评估，再决定按阶梯选择镇痛药物。CTP评分标准（B错）肝功能不全分级的评估系统。Cochrane证据分级（C错）为循证医学证据分级的基本依据。APACHE评分系统（D错）为急性生理学及慢性健康状况评分系统。Beers标准（E错）为老年人潜在不当用药的标准。